精密称取200mg样品时，选用分析天平的感应量应为
A. 10mg
B. 1mg
C. 0.1mg
D. 0.01mg
E. 0.001mg

正确答案：C。0.1mg

解析：本题考查中国药典的凡例。精密称取200mg样品时，选用分析天平的感应量应为0.1mg（C对）。“精密称取”系指称取量应准确至所取总量的千分之一，题干中精密称取200mg时，称取重量应准确至200mg的千分之一即0.2mg，因此天平的感应量应为0.1mg。